当1，4-二氢吡啶类药物的C-2位甲基改-CH₂OCH₂CH₂NH₂后活性得到加强，临床常用其苯磺酸盐的药物是
A. 硝苯地平
B. 尼群地平
C. 尼莫地平
D. 氨氯地平
E. 尼卡地平

正确答案：D。氨氯地平

解析：本题考查氨氯地平的结构。氨氯地平（D对）为1，4-二氢吡啶类钙通道阻滞剂，其分子中的1，4-二氢吡啶环的2位甲基被2-氨基乙氧基甲基取代，其活性强，临床常用其苯磺酸盐。硝苯地平（A错）为对称结构的二氢吡啶类药物，用于治疗冠心病，缓解心绞痛，同时适用于各种类型的高血压。尼群地平（B错）的1，4-二氢吡啶环上所连接的两个羧酸酯的结构不同，使其4位碳原子具手性，临床用外消旋体，用于治疗高血压和充血性心衰。尼莫地平（C错）容易通过血脑屏障而作用于脑血管及神经细胞，选择性扩张脑血管，在增加脑血流量的同时不影响脑代谢，具有抗缺血和抗血管收缩作用。尼卡地平（E错）为胺类化合物，可转化为亚硝基代谢中间体，与血红素的铁离子螯合产生抑制作用。